39岁初产妇，妊娠39周，于晨4时临产，10时破膜，20时查宫口开大2cm，此时应诊断为
A. 潜伏期延长
B. 活跃期延长
C. 活跃期停滞
D. 第二产程停滞
E. 第二产程延长

正确答案：A。潜伏期延长

解析：该初产妇，于晨4时临产，20时20分查宫口开大2cm，历时16小时20分钟（超过16小时），故诊断为潜伏期延长（A对）。活跃期是指宫口扩张3-10cm，活跃期延长（B错）为活跃期超过8小时。活跃期停滞（C错）是指活跃期宫口扩张停止＞4小时。无第二产程停滞（D错）的说法。第二产程延长（E错）是指初产妇第二产程＞2小时（硬膜外麻醉无痛分娩时以超过3小时为准），经产妇第二产程＞1小时。本题按照第八版妇产科学内容正确答案为A，按照第九版妇产科学本题无正确答案。